肾功能不良的患者禁用
A. 青霉素G
B. 耐酶青霉素类
C. 广谱青霉素
D. 第一代头孢菌素
E. 第三代头孢菌素

正确答案：D。第一代头孢菌素